女，33岁。右上腹痛3天，有压痛和反跳痛，murphy征（+），WBC18.1×10⁹/L，最可能的病理变化为
A. 渗出纤维素
B. 卡他性炎症
C. 蜂窝织炎
D. 出血性炎
E. 化脓性炎

正确答案：E。化脓性炎

解析：年轻女性患者，右上腹痛、压痛、反跳痛，Murphy征阳性（胆囊炎体征），白细胞18.1×10⁹/L（正常值4～10×10⁹/L，升高提示感染）。考虑为急性化脓性胆囊炎，最可能的病理变化为化脓性炎（E对）。